肾动脉
A. 经肾静脉、肾盂后方入肾门
B. 起于腹主动脉
C. 左肾动脉起端部位高于右侧，长度较右侧略长
D. 只分布到肾
E. 无

正确答案：B。起于腹主动脉

解析：肾动脉约平第1～2腰椎椎间盘的高度起于腹主动脉（B对）。经肾门入肾（A错）。在进入肾门之前发出肾上腺下动脉至肾上腺（D错）。